眶下间隙界限的描述错误的是
A. 位于眼眶下方上颌骨前壁与面部表情肌之间
B. 上界为眶下缘
C. 下界为上颌骨牙槽突
D. 内界为蝶骨大翼
E. 外界为颧骨

正确答案：D。内界为蝶骨大翼

解析：眶下间隙位于眼眶下方上颌骨前壁与面部表情肌之间。其上界为眶下缘，下界为上颌骨牙槽突，内界为鼻侧缘，外界为颧骨。掌握“间隙感染概述、眶下间隙、咬肌间隙感染”知识点。